中药饮片正名是规范化的饮片名称，除正名以外的名称为别名。“青果”的别名是
A. 西青果
B. 橄榄
C. 诃子
D. 使君子
E. 玉果

正确答案：B。橄榄

解析：本题考查的是常见的饮片正名与相关别名。中药饮片正名是规范化的饮片名称，除正名以外的名称为别名。“青果”的别名是橄榄（B对）。青果别名：干青果、橄榄。诃子（C错）别名：诃子肉、诃黎勒。肉豆蔻别名：肉果、玉果（E错）。